关节沿冠状轴可作
A. 屈和伸
B. 收和展
C. 旋转
D. 环转
E. 无

正确答案：A。屈和伸

解析：关节沿冠状轴做屈、伸（A对）运动。收和展（B错）是关节沿矢状轴做的运动。旋转（C错）是关节沿垂直轴做的运动。环转（D错）运动是关节上端不动，下端做圆周运动做出的运动。